呈螺旋状弯曲，长2.5～4.0μm的是
A. 弧菌
B. 螺菌
C. 螺杆菌
D. 弯曲菌
E. 杆菌

正确答案：C。螺杆菌

解析：螺杆菌，呈螺旋状弯曲，长2.5～4.0μm，如幽门螺杆菌。掌握“细菌的特殊结构及检查方法”知识点。